属于哌啶类镇痛药的是
A. 盐酸美沙酮
B. 枸橼酸芬太尼
C. 盐酸纳洛酮
D. 酒石酸布托啡诺
E. 苯噻啶

正确答案：B。枸橼酸芬太尼

解析：本题考查哌替啶类镇痛药。属于哌啶类镇痛药的是枸橼酸芬太尼（B对）。在4-苯基哌啶类结构中，哌啶环的4位引入苯氨基，并在苯基氨基的氮原子上丙酰化得到4-苯氨基哌啶类结构的强效镇痛药，代表药物是枸橼酸芬太尼。盐酸美沙酮（A错）属于氨基酮类镇痛药，其结构仅仅保留了吗啡的A环结构，为高度柔性的开链吗啡类似物。纳洛酮（C错）为半合成的镇痛药，是由吗啡的N-甲基被烯丙基、环丙基甲基或环丁基甲基等取代后得到的。酒石酸布托啡诺（D错）属于吗啡喃类镇痛药。苯噻啶（E错）属于抗组胺类镇痛药，并有很强的抗组胺和较弱的抗乙酰胆碱作用。